复方当归四物汤与妇科千金片同用后，能提高的是
A. 止痉效果
B. 止痛效果
C. 止血效果
D. 止泻效果
E. 止带效果

正确答案：B。止痛效果

解析：本题考查中成药与中药汤剂的联合应用。复方当归四物汤与妇科千金片同用后，能提高的是止痛效果（B对）。复方当归四物汤与妇科千金片同用后可使痛经减轻，并能促进子宫发育，减少分泌物，减轻炎症。归脾丸与人参养荣丸同用，可明显增强补益心脾、益气养血、安神止痉（A错）的功效，治疗心悸失眠、眩晕健忘。抗肿瘤药氟尿嘧啶与环磷酰胺常产生呕吐、恶心等胃肠道反应，而海螵蛸和白及粉既能止血（C错）消肿，又能保护胃黏膜，联用对治疗消化道肿瘤有较好疗效。附子理中丸与四神丸合用，可以增强温肾运脾、涩肠止泻（D错）的功效，治疗脾肾阳虚之五更泄泻。